饮水中硝酸盐增高易引起婴幼儿患的疾病是
A. 营养不良
B. 克汀病
C. 皮肤色素沉着
D. 高铁血红蛋白血症
E. 骨软化症

正确答案：D。高铁血红蛋白血症

解析：本题考查饮水中硝酸盐增高易引起婴幼儿患的疾病。当人体摄入硝酸盐后，在胃肠道某些细菌作用下，可还原成亚硝酸盐，亚硝酸盐与血红蛋白结合则形成高铁血红蛋白。当婴幼儿特别是六个月以内的婴儿血中10%左右的血红蛋白转变为高铁血红蛋白时，即可出现发绀等缺氧症状，也称蓝婴综合征。因此饮水中硝酸盐增高易引起婴幼儿患高铁血红蛋白血症（D对ABCE错）。